以下哪种病变的镜下表现为肉芽肿结构
A. 婴儿血管瘤
B. 成牙骨质细胞瘤
C. 纤维性龈瘤
D. 嗜酸性淋巴肉芽肿
E. 鳞状细胞乳头状瘤

正确答案：D。嗜酸性淋巴肉芽肿

解析：嗜酸性淋巴肉芽肿镜下表现为肉芽肿结构。掌握“血管瘤及嗜酸性淋巴肉芽肿”知识点。